女性，45岁。被鱼刺扎伤右手食指尖2天，右手食指针刺样痛半天就诊。査体：T36.8度，右手食指末节轻度肿胀压痛，但张力不高，皮肤不红。该病的诊断是
A. 甲沟炎
B. 指头炎
C. 指骨髓炎
D. 腱鞘炎
E. 滑囊炎

正确答案：B。指头炎

解析：患者右手示指尖刺伤史2天，针刺样痛半天，右手示指末节轻度肿胀、压痛，考虑右手示指末节指头炎（多因指尖、手指末节皮肤受伤后引起，初起有针刺样痛，轻度肿胀）（B对）。甲沟炎（A错）是皮肤沿指甲两侧形成的甲沟及其周围组织的化脓性细菌感染，常发生在一侧甲沟皮下。指骨骨髓炎（C错）为脓性指头炎未及时切开引流，导致指骨缺血坏死的一种晚期并发症。指头炎发展为指骨髓炎的过程中疼痛反而减轻，皮肤由红转白。腱鞘炎（P113）（D错）常表现为除末节外，患指中、近指节均匀性肿胀，皮肤极度紧张。示指感染常蔓延至鱼际间隙，很少引起滑囊炎（E错）。